根据健康教育的知信行理论，下列表述不正确的是
A. 知识是改变健康相关行为的基础
B. 信念是行为改变的动力
C. 正确态度的建立有可能改变危害健康的行为
D. 知识的增加总是伴随行为的改变
E. 健康教育目标是行为改变

正确答案：D。知识的增加总是伴随行为的改变